血友病的特征不包括
A. 阳性家族史
B. 发病较晚
C. 自发或轻度外伤后出血不止
D. 血肿形成
E. 关节出血

正确答案：B。发病较晚

解析：血友病是一组因遗传性凝血活酶生成障碍引起的出血性疾病。以阳性家族史、幼年发病(生之具有，伴随终身)、自发或轻度外伤后出血不止、血肿形成及关节出血为特征。掌握“血友病”知识点。